女，62岁。绝经11年，阴道反复流血4个月就诊。查体：肥胖，一般情况好，血压150/105mmHg。妇科检查：阴道少许血液，宫颈光滑，子宫正常大，双附件正常。确诊的最佳方法是
A. 宫腔涂片细胞学检查
B. 宫颈管细胞学检查
C. 宫颈活检
D. 宫腔镜检查
E. 子宫分段诊刮

正确答案：E。子宫分段诊刮

解析：患者为老年妇女，出现绝经后阴道不规则流血（子宫内膜癌的主要表现为绝经后阴道流血），查体：肥胖（肥胖为子宫内膜癌发病高危因素），一般情况好，血压150/105mmHg。妇科检查：阴道少许血液，宫颈光滑，子宫正常大，双附件正常，首先应考虑子宫内膜癌。为明确诊断，最佳方法是行分段诊刮（E对）。宫腔涂片细胞学检查（A错）、宫颈管细胞学检查（B错）都只能用于子宫恶性肿瘤的筛查，不能确诊。宫颈活检（C错）主要用于确诊宫颈癌而不是子宫内膜癌。宫腔镜检查（P316）（D错）可直接观察宫腔及宫颈管内有无癌灶存在，癌灶大小及部位，直视下取材活检，对局灶型子宫内膜癌的诊断更为准确。